虚里搏动“数急而时有一止”的临床意义是
A. 心阳不足
B. 心肺气绝
C. 饮停心包
D. 宗气不守
E. 痘疹将发

正确答案：D。宗气不守

解析：虚里位于左乳下第四、五肋间，乳头下稍内侧，为心尖搏动处，系诸脉之所宗，又为宗气之外候。在病理情况下，虚里搏动数急而时有一止，为宗气不守（D对）。虚里搏动迟弱，或久病体虚而动数者，多为心阳不足（A错）。虚里搏动散漫而数，伴胸高而喘者，为心肺气绝之兆（B错）。虚里按之其动微弱者为不及，多是宗气内虚之征，亦可因饮停心包所致（C错）。虚里动高，聚而不散者，为热甚，多见于外感热邪、小儿食滞或痘疹将发之时（E错）。